厥阴经证可见
A. 头顶痛
B. 偏头痛
C. 全头痛
D. 巅顶痛
E. 面额痛

正确答案：D。巅顶痛

解析：多在巅顶部位，或连目系（D对）；太阳头痛，痛在脑后，下连于项（A错）；肝经风火上扰，见偏头痛（B错）；太阴、少阴头痛多以全头疼痛为主（C错）；厥阴头痛，阳明头痛，在前额部及眉棱骨处（E错）。